原发型肺结核好发人群
A. 婴幼儿
B. 老年人
C. 青壮年
D. 育龄妇女
E. 少年儿童

正确答案：E。少年儿童

解析：原发型肺结核：包括原发综合征及胸内淋巴结结核。多见于少年儿童，无症状或症状轻微，多有结核病家庭接触史，结核菌素试验多为强阳性。掌握“肺结核”知识点。